下列选项，不属于“因人制宜”原则的是
A. 因性别不同而用药各异
B. 因居处环境不同而用药各异
C. 团体质不同而用药各异
D. 因年龄不同而用药各异
E. 因老幼不同而用药各异

正确答案：B。因居处环境不同而用药各异

解析：根据患者的年龄、性别、体质、生活习惯等不同特点，制定适宜治法和方药的原则，称为“因人制宜”（ACDE对）。根据不同的地域环境特点，制定适宜治法和方药的原则，称为“因地制宜”（B错，为本题正确答案）。